急性肝衰竭时不可能出现
A. 转氨酶正常
B. 胆红素正常
C. 血小板减少
D. 纤维蛋白原减少
E. 电解质失衡

正确答案：B。胆红素正常

解析：急性肝衰竭时实验室检查：①转氨酶升高，但大面积肝坏死时可出现胆-酶分离现象，此时胆红素持续升高，而转氨酶不升高（A对）。②血胆红素增高（B错，为正确答案）。③血小板减少（C对），白细胞增多。④血肌酐或尿素氮可增高。⑤血电解质紊乱（E对）。⑥酸碱失衡，多为代谢性酸中毒。⑦发生DIC时，凝血时间、凝血酶原时间或部分凝血活酶时间延长，纤维蛋白原可减少（D对），而其降解物（FDP）增多，优球蛋白实验等可呈阳性。